肺痨的治疗原则是
A. 清热解毒，清肺化痰
B. 早期联合适量规律全程
C. 早期联合大量规律间歇
D. 祛邪利肺纳气平喘
E. 补虚培元抗痨杀虫

正确答案：E。补虚培元抗痨杀虫

解析：中医认为肺痨（肺结核）的发生主要是由于正气亏虚，和痨虫侵袭导致的，当以抗痨杀虫，补虚培元为治则（E对）。清热解毒，清肺化痰是用于肺部痰热实证疾病的治疗方法，肺痨多以阴虚为主（A错）。早期联合适量规律全程为西医抗结核治疗的基本原则（BC错）。祛邪利肺纳气平喘常用于治疗肺肾气虚不能纳气导致的喘证（D错）